卡马西平在体内代谢生成有毒性的环氧化物，发生的代谢反应是
A. 芳环羟基化
B. 硝基还原
C. 烯烃氧化
D. N-脱烷基化
E. 乙酰化

正确答案：C。烯烃氧化

解析：本题考查药物化学结构与第Ⅰ相生物转化的规律。卡马西平在体内代谢生成有毒性的环氧化物，发生的代谢反应是烯烃氧化（C对）。烯烃化合物π键活性大于芳香烃， 因此会被氧化，代谢生成环氧化合物。